下列各项，不属麻黄汤证表现的是
A. 恶寒发热
B. 鼻鸣干呕
C. 头身疼痛
D. 无汗而喘
E. 脉浮紧

正确答案：B。鼻鸣干呕

解析：麻黄汤证临床表现有恶寒发热，头身疼痛，无汗而喘，舌苔薄白，脉浮紧，无鼻鸣干呕是桂枝汤的临床表现（B对）。